出现机体失代偿的表现是一般丢失的血容量已达到
A. 15%以下
B. 15%以上
C. 20%以上
D. 30%以上
E. 50%以上

正确答案：C。20%以上

解析：随着休克的发展，患者常常意识淡漠，脉搏细速，脉压变小，四肢湿冷，尿少等症状，一旦出现收缩压下降，表明血容量丢失达到20%以上，是机体失代偿的表现。掌握“口腔颌面部创伤急救”知识点。